护士为HIV阳性患者护理时，不慎接触该患者的血液。关于暴露处理的说法，正确的有
A. 用肥皂或流动的清水清洗被污染的局部
B. 存在伤口时，应轻柔地由近心端向远心端挤压伤处
C. 预防性用药应持续14天
D. 用75%酒精或0.5%碘伏对伤口进行消毒、包扎
E. 发生暴露后尽可能在最短时间内（2h内）预防性用药

正确答案：A、B、D、E。用肥皂或流动的清水清洗被污染的局部；存在伤口时，应轻柔地由近心端向远心端挤压伤处；用75%酒精或0.5%碘伏对伤口进行消毒、包扎；发生暴露后尽可能在最短时间内（2h内）预防性用药

解析：本题考查HIV暴露处理与预防阻断。HIV暴露后局部处理原则：（1）用肥皂液和流动的清水清洗被污染局部。（2）污染眼部等黏膜时，应用大量等渗氯化钠溶液反复冲洗（E对）。（3）存在伤口时，应轻柔地由近心端向远心端挤压（A对）伤处，尽可能挤出损伤处的血液，再用肥皂液和流动的清水冲洗伤口。（4）用75%酒精或0.5%碘伏对伤口局部进行消毒、包扎（B对）处理。暴露后预防性用药原则：在发生HIV暴露后尽可能在最短的时间内（尽可能在2小时内）进行预防性用药（D对），最好不超过24小时时；但即使超过24小时，也建议实施预防性用药。用药疗程为连续服用28日（C错）。